地面水防护时，不得排入工业废水和生活污水的水域范围为
A. 取水点上游10m至下游500m
B. 取水点上游50m至下游1000m
C. 取水点上游100m至下游500m
D. 取水点上游1000m至下游100m
E. 取水点上游500m至下游100m

正确答案：D。取水点上游1000m至下游100m

解析：本题考查地表水水源卫生防护规定。地面水防护时，取水点上游1000m至下游100m（D对ABCE错）的水域内不得排入工业废水和生活污水。其沿岸防护范围内不得堆放废渣，不得设立有毒有害化学物品仓库、堆栈，不得构筑装卸垃圾、粪便和有毒有害化学物品的码头，不得使用工业废水或生活污水灌溉及施用难降解或剧毒的农药，不得排放有毒气体、放射性物质，不得从事放牧等有可能污染该水域水质的活动。